与急性胰腺炎时诱发DIC的机制有关的是
A. 大量胰蛋白酶入血激活凝血酶原
B. 大量胰脂肪酶入血激活凝血酶原
C. 大量胰淀粉酶入血激活凝血酶原
D. 大量组织凝血酶入血
E. 单核吞噬细胞系统功能障碍

正确答案：A。大量胰蛋白酶入血激活凝血酶原

解析：急性胰腺炎是，大量胰蛋白酶入血，除了激活因子Ⅻ外，还可以激活因子X和凝血酶原，促使凝血酶大量形成（A对）。胰蛋白酶主要作用于血管上皮，血管上皮与凝血功能有关。